患者第8胸髓节段左侧后索损伤后可能出现
A. 左侧半身肋弓平面以下本体感觉和精细触觉消失或减退
B. 左侧半身脐平面以下本体感觉和精细触觉丧失或减退
C. 右侧半身肋弓平面以下本体感觉和精细触觉丧失或减退
D. 右侧半身脐平面以下本体感觉和精细触觉丧失或减退
E. 无

正确答案：A。左侧半身肋弓平面以下本体感觉和精细触觉消失或减退

解析：当脊髓后索病变时，本体感觉和精细触觉的信息不能向上传，第8胸髓节段对应表面位置应为肋弓平面，因此第8胸髓节段左侧后索损伤后可能出现左侧半身肋弓平面以下本体感觉和精细触觉消失或减退（A对）。